《小儿药证直诀》把小儿生理病理特点概括为
A. 脏腑柔弱，易虚易实，易寒易热
B. 脏腑娇嫩，形气未充
C. 生机蓬勃，发育迅速
D. 发病容易，传变迅速
E. 脏气清灵，易趋康复

正确答案：A。脏腑柔弱，易虚易实，易寒易热

解析：钱乙为儿科之圣，其代表作为《小儿药证直诀》，将小儿生理病理特点概括为“脏腑柔弱、易虚易实、易寒易热”，且首创儿科五脏辨证体系及从五脏论治（A对）。脏腑娇嫩，形气未充是指小儿五脏六腑的形与气皆属不足，五脏六腑的功能状况不够稳定，由《黄帝内经》提出（B错）。生机蓬勃，发育迅速由《颅囟经·脉法》延伸，意指小儿的机体在形态结构方面及生理功能方面都在不断地、迅速地发育成长（C错）。发病容易，传变迅速指小儿机体不够成熟，御邪能力较弱，容易被外邪所伤，病情多变而迅速传变，非钱乙所提出（D错）。脏气清灵，易趋康复为小儿的机体生机蓬勃，脏腑之气清灵，对各种治疗反应灵敏，病情好转的速度较成人为快、疾病治愈的可能性也较成人为大，非钱乙所提出（E错）。